甘油磷脂合成最活跃的组织是
A. 肺
B. 脑
C. 骨
D. 肝
E. 肌肉

正确答案：D。肝

解析：全身各组织细胞内质网均有合成磷脂的酶系，因此均能合成甘油磷脂，但以肝、肾及肠等组织最活跃。掌握“甘油磷脂、胆固醇和血脂蛋白代谢”知识点。